维系DNA两条链形成双螺旋的化学键是
A. 磷酸二酯键
B. N-C糖苷键
C. 戊糖内C-C键
D. 碱基内C-C键
E. 碱基间氢键

正确答案：E。碱基间氢键

解析：本题考查DNA。维系DNA两条链形成双螺旋的化学键是碱基间氢键（E对）。1.DNA中碱基的化学结构特征决定了两条链之间的特有相互作用方式：一条链上的腺嘌呤与另一条链上的胸腺嘧啶形成了两对氢键；一条链上的鸟嘌呤与另一条链上的胞嘧啶形成了三对氢键。这种特定的碱基之间的作用关系称为互补碱基对，DNA的两条链则称为互补链。2.磷酸二酯键（A错）是一种化学基团，指一分子磷酸与两个醇（羟基）酯化形成的两个酯键。如前一个核苷酸的羰基中的3碳上′-OH（羟基）和后一个核苷酸的5′-磷酸基形成酯键，此处的磷酸基同时与前后两个羟基形成酯键，故称磷酸二酯键。依次连下去，形成多核苷酸链，即核酸大分子链。